下列经脉中，其循行环绕口唇的是
A. 胆经胃经肝经任脉
B. 肾经任脉胆经冲脉
C. 脾经肝经任脉冲脉
D. 心经脾经肝经胃经
E. 胃经肝经冲脉任脉

正确答案：E。胃经肝经冲脉任脉

解析：该题目考察特殊部位的经络循行所过，需考生准确记忆。如循行环绕口唇的经脉有胃经、肝经、冲脉、任脉（E对），通过眶下的经脉有冲脉和任脉，经过上唇的经脉是督脉，经过头顶的经脉有膀胱经、肝经、督脉，经过气街的经脉有胆经、胃经、冲脉等。以上内容可简记为：“肝胃冲任环口唇，冲任眶下督上唇，胆胃冲脉过气街，头顶肝经膀胱督”。